可渗透过甲板用于角化增厚型足癣的抗真菌药是
A. 联苯苄唑
B. 益康唑
C. 比萘芬
D. 克霉唑
E. 环吡酮胺

正确答案：E。环吡酮胺

解析：本题考查抗真菌药。可渗透过甲板用于角化增厚型足癣的抗真菌药是环吡酮胺（E对）。环吡酮胺作用于真菌细胞膜。高浓度使细胞膜的渗透性增加，钾离子和其他内容物漏出，细胞死亡。此药渗透性强，可渗透过甲板。外用治疗由皮肤瘤菌所致的浅表皮肤真菌感染，如手癣，足癣、体癣、股癣；亦可用于头癣；外用于白念珠菌等所致的皮肤念珠菌感染和念珠菌性外阴阴道炎。外用于马拉色菌属所致的花斑癣。联苯苄唑（A错）、益康唑（B错）、特比萘芬（C错）、克霉唑（D错）都可用于治疗足癣，但不能渗透过甲板。